患者，女，50岁，近期出现失眠、潮热、出汗、烦躁等不适症状，临床诊断为围绝经期综合征，在使用激素替代治疗之前应先排除禁忌症。下列情况不属于禁忌证但属于慎用的是
A. 乳腺增生
B. 近6月内患活动性静脉栓塞性疾病
C. 严重肝功能障碍
D. 耳硬化症
E. 脑膜瘤

正确答案：A。乳腺增生

解析：本题考查绝经激素的禁忌症与慎用情况。慎用情况并非禁忌证，但在治疗前和治疗过程中，应该咨询相关专业的医师，共同确定治疗时机和方式，并采取比常规随诊更为严密的措施，监测病情的进展。包括子宫肌瘤、子宫内膜异位症、子宫内膜增生史、尚未控制的糖尿病及严重高血压、有血栓形成倾向、胆囊疾病、癫痛、哮喘、高催乳素血症、系统性红斑狼疮、乳腺良性增生（A对）疾病、乳腺癌家族史，以及完全缓解的部分性激素依赖性恶性肿瘤（如子宫内膜癌、卵巢上皮性癌等）。近6月内患活动性静脉栓塞性疾病（B错）、严重肝肾功能障碍（C错）、耳硬化症（D错）、脑膜瘤（E错）均为绝经激素治疗的禁忌证。